男，44岁。感冒后进行性四肢无力伴麻木，对称性痛温振动觉消失，无汗，伴尿潴留。考虑患者为
A. 急性硬脊膜外脓肿
B. 脊柱结核
C. 急性脊髓炎
D. 转移性肿瘤
E. 脊髓出血

正确答案：C。急性脊髓炎

解析：急性脊髓炎的典型特点即为发病前的感染或疫苗接种史，1-2周后出现某一平面以下的肢体麻木无力、痛温觉障碍以及二便障碍等横贯性神经受损表现。本例患者青壮年男性，感冒（上呼吸道感染史）后进行性四肢无力伴麻木，对称性痛温振动觉消失，无汗，伴尿潴留（横贯性神经受损表现），诊断为急性脊髓炎（C对）。急性硬脊膜外脓肿（A错）临床表现与急性脊髓炎相似，但有化脓病灶及感染史，病变部位有压痛，还有锥管梗阻至颅内压升高征象。脊柱结核（B错）会伴有低热、盗汗等结核症状，且病变进展慢，影像学检查容易鉴别。转移性肿瘤（D错）会有原发癌灶的表现，脊柱影像学检查及全身骨扫描可以鉴别。脊髓出血（E错）多有外伤史，起病急骤，伴有剧烈背痛，肢体瘫痪和尿便潴留。